男，18岁。缓慢起病，头痛、乏力、肌痛，胸部X线片示双下肺间质性肺炎。最可能的诊断是
A. 金黄色葡萄球菌肺炎
B. 肺炎链球菌肺炎
C. 肺炎支原体肺炎
D. 铜绿假单胞菌肺炎
E. 肺炎克雷伯杆菌肺炎

正确答案：C。肺炎支原体肺炎

解析：患者青少年男性，缓慢起病，头痛、乏力、肌痛，胸部X线片示双下肺间质性肺炎（肺炎支原体肺炎典型症状）。最可能的诊断是肺炎支原体肺炎（C对）。金黄色葡萄球菌肺炎（A错）起病多急骤，寒战、高热，胸痛，痰脓性，量多，X线影像表现为坏死性肺炎肺炎。肺炎链球菌（B错）引发的肺炎发病前常有受凉、淋雨、疲劳、醉酒、病毒感染史，多有上呼吸道感染的前驱症状，多急骤起病，以高热、寒战、咳嗽、血痰及胸痛为特征。X线影像呈肺段或肺叶急性炎性实变。铜绿假单胞菌（D错）经常引起术后伤口感染，也可引起褥疮、脓肿、化脓性中耳炎等。克雷伯杆菌肺炎（E错）多有咳砖红色胶冻样痰。